患者呃声洪亮，冲逆而出，口臭烦渴，喜冷饮，小便短赤，大便秘结，舌苔黄，脉滑数。其治法是
A. 清胃化痰止呃
B. 清热化湿降逆
C. 清热化瘀止呃
D. 清胃平肝降逆
E. 清降泻热止呃

正确答案：E。清降泻热止呃

解析：患者以呃声洪亮，冲逆而出为主症，故诊断为呃逆。热积胃肠。腑气不通，胃火上冲则口臭烦渴，喜冷饮；腑气不通则大便秘结。小便短赤，大便秘结，舌苔黄，脉滑数为胃热内盛之象，故应为胃火上逆证。治宜清降泻热止呃（E对）。题干中无湿的症象（B错）。题干中无胸胁刺痛，舌紫黯等瘀血症象故（C错）。清胃平肝降逆用于气机郁滞证（D对）。